味蕾最多的是
A. 颊黏膜
B. 舌背
C. 硬腭
D. 舌腹
E. 唇红

正确答案：B。舌背

解析：本题考查味蕾。味蕾最多的是舌背（B对）。菌状乳头、轮廓乳头和叶状乳头含味蕾，司味觉，是舌背的表面标志。所以味蕾最多的是舌背。颊黏膜（A错）、硬腭（C错）、舌腹（D错）、唇红（E错）均无味蕾。